唾液分泌量中，舌下腺占
A. 2%～4%
B. 7%～8%
C. 22%～30%
D. 60%～65%
E. 80%～90%

正确答案：A。2%～4%

解析：舌下腺占2%～4%。掌握“唾液的分泌和功能”知识点。